使肠蠕动加快的植物性神经低级中枢在
A. 中脑
B. 脑桥
C. 延髓
D. 脊髓胸腰段前角
E. 脊髓胸腰段侧角

正确答案：C。延髓

解析：使肠蠕动加快的植物性神经为副交感神经，其低级中枢位于脑干的一般内脏运动核和脊髓骶部第2-4节段灰质的骶副交感核，即延髓部（C对）。